按照美国PSI指数原理建立的我国大气质量指数是
A. 大气质量综合指数
B. 大气质量指数11
C. 空气污染指数AP1
D. Brown指数
E. 橡树林大气质量指数

正确答案：C。空气污染指数AP1